丘脑核团的联系
A. 腹后外侧核接受三叉丘系
B. 内侧丘系投射到内侧膝状体
C. 外侧丘系投射到外侧膝状体
D. 腹外侧核接受头面部感觉投射
E. 以上都不对

正确答案：E。以上都不对

解析：间脑中的背侧丘脑可分为三个核群：前核群、内侧核群、外侧核群。外侧核群又可分为背、腹两层，腹层分为腹前核、腹外侧核、腹后核。腹前核和腹外侧核（D错），主要接受小脑齿状核、苍白球和黑质传入纤维，调节躯体运动。腹后核又可分为腹后外侧核、腹后内侧核，腹后外侧核（A错）接受内侧丘系（B错）和脊髓丘系的纤维，传导躯干、四肢感觉；腹后内侧核接受三叉丘系和由孤束核发出的纤维，传导头面部感觉。外侧丘系（C错）投射的位置为内侧膝状体，传导听觉。因而E为本题正确答案。